在突发公共卫生事件应急处理工作中，有关单位和个人拒绝有关专业技术机构的人员进入突发事件的现场，不配合有关专业技术人员调查、采样、技术分析和检验的，并触犯《中华人民共和国刑法》，对有关责任人给予
A. 警告
B. 吊销执照
C. 降级或者撤职的纪律处分
D. 行政处分或者纪律处分
E. 追究刑事责任

正确答案：E。追究刑事责任